某患儿，7岁，行为刻板重复，智力低下，与他人存在交流障碍，但无认知-语言发有障碍。医生在对儿童进行行为指导的时候应遵循治疗的道德准则，下列哪项符合道德准则
A. 实施指导未取得被矫治儿童父母同意
B. 实施计划不公开
C. 选用对儿童具有最大功效及最小伤害的方法
D. 使用惩罚式的方法
E. 指导者尚未取得相应的资格

正确答案：C。选用对儿童具有最大功效及最小伤害的方法